原发性重症联合免疫缺陷病所涉及的细胞是
A. 单核巨噬细胞
B. 粒细胞
C. B细胞与T细胞
D. T细胞与NK细孢
E. 肥大细胞

正确答案：C。B细胞与T细胞

解析：原发性重症联合免疫缺陷病属于联合性免疫缺陷病，是一种体液免疫、细胞免疫同时具有严重缺陷的疾病，所涉及的细胞是B淋巴细胞与T淋巴细胞（C对），一般T细胞免疫缺陷更为突出。